某男性患者，37岁，体检查出空腹血糖9.79mmol/L，尿糖（++），本人无明显不适。入院复查餐后血糖、糖化血红蛋白，医师诊断为2型糖尿病，并给予磺酰脲类降糖药。该降血糖药的不良反应主要是
A. 乳酸血症
B. 黏膜出血
C. 低血糖
D. 肾上腺皮质功能减退
E. 肾上腺皮质功能亢进

正确答案：C。低血糖

解析：本题考查磺酰脲类降糖药的不良反应。某男性患者，37岁，体检查出空腹血糖9.79mmol/L，尿糖（++），本人无明显不适。入院复查餐后血糖、糖化血红蛋白，医师诊断为2型糖尿病，并给予磺酰脲类降糖药。该降血糖药的不良反应主要是低血糖（C对）。乳酸血症（A错）可见于双胍类药物。磺酰脲类降糖药不会引起黏膜出血（B错）、肾上腺皮质功能减退（D错）、肾上腺皮质功能亢进（E错）。